关于龈沟液的叙述中不正确的是
A. 牙龈健康者极少量龈沟液
B. 炎症时龈沟液明显增多
C. 液体成分主要来源于血清
D. 龈沟液中有免疫球蛋白具有抗特异性致病菌的作用
E. 龈沟液中无白细胞等防御细胞

正确答案：E。龈沟液中无白细胞等防御细胞

解析：本题考查龈沟液。关于龈沟液的叙述中不正确的是龈沟液中无白细胞等防御细胞（E错，为本题的正确答案）。龈沟液系指通过龈沟内上皮和结合上皮从牙龈结缔组织渗入到龈沟内的液体。龈沟液的液体成分主要来源于血清（C对），其他成分则分别来自血清、邻近的牙周组织（上皮、结缔组织）及细菌。内容包括补体抗体系统成分、各种电解质、蛋白质、葡萄糖、酶等，也含有白细胞（主要为通过龈沟上皮迁移而出的中性粒细胞）、脱落的上皮细胞等。1.牙龈健康者只有极少量龈沟液（A对），由组织内的渗透梯度而使组织液渗入龈沟内。因为健康的牙龈也可能有少量的龈下菌斑，菌斑微生物产生一定量的大分子产物，这些产物可扩散而聚集于基底膜处，从而产生持续的渗透梯度，形成龈沟液流。2.龈沟液量增多是牙龈炎症早期的主要表现之一，常早于临床表征的改变。牙龈炎症明显时，龈沟液量明显增多（B对）。3.龈沟液中的免疫球蛋白与口腔防御功能有关，具有针对不同致病菌的特异抗体功能（D对），其中lgG水平高于IgA和IgM。特异性抗体可通过阻止细菌附着、调理吞噬和与细菌形成抗原抗体复合物等作用来阻止细菌的入侵。4.在炎症时，龈沟液中的炎症介质水平增高，如IL-1、前列腺素E2（PGE2）等。5.白细胞是龈沟液中的重要防御细胞。龈沟内的大多数白细胞均有活性，具有吞噬和杀菌能力。6.龈沟液中含有多种酶，其中天冬氨酸转氨酶、碱性磷酸酶、胶原酶等与牙周病的严重程度和活动期等有一定的关系。